肝硬化患者最严重的并发症是
A. 低钠血症
B. 肺部感染
C. 肝肾综合征
D. 自发性腹膜炎
E. 肝性脑病

正确答案：E。肝性脑病

解析：肝硬化的并发症包括上消化道出血、肝性脑病、感染、肝肾综合征、原发性肝癌、水电解质和酸碱平衡紊乱。其中上消化道出血为最常见并发症；肝性脑病为最严重并发症（E对），是肝硬化最常见的死亡原因。低钠血症（A错）、肺部感染（B错）、肝肾综合征（C错）、自发性腹膜炎（D错）均为肝硬化的并发症，但不是最严重的类型。